脂酰CoA进入线粒体的限速酶
A. 肉碱脂酰转移酶Ⅰ
B. 肉碱脂酰转移酶Ⅱ
C. 脂酰CoA脱氢酶
D. 烯酰CoA水化酶
E. 肉碱-脂酰肉碱转位酶

正确答案：A。肉碱脂酰转移酶Ⅰ

解析：脂酰CoA进入线粒体是脂肪酸β－氧化的限速步骤，肉碱脂酰转移酶Ⅰ是脂肪酸β－氧化的关键酶（A对）。肉碱脂酰转移酶Ⅰ催化长链脂酰CoA与肉碱合成脂酰肉碱，后者在线粒体内膜肉碱－脂酰肉碱转位酶（E错）作用下，通过内膜进入线粒体基质，同时将等分子肉碱转运出线粒体。进入线粒体的脂酰肉碱，在线粒体内膜内侧肉碱脂酰转移酶Ⅱ（B错）作用下，转变为脂酰CoA并释出肉碱。脂酰CoA在脂酰CoA脱氢酶（C错）催化下，从a、β碳原子各脱下一个氢原子，由FAD接受生成FADH，同时生成反△2烯脂酰CoA。反△2烯脂酰CoA在烯酰CoA水化酶（D错）催化下，加水生成L(+)-β－羟脂酰CoA。